注射用辅酶A冻干制剂中作稳定剂的是
A. 卵磷脂
B. 碳酸氢钠
C. 半胱氨酸
D. 聚乙二醇
E. 聚氧乙烯蓖麻油

正确答案：C。半胱氨酸

解析：本题考查注射用辅酶A冻干制剂的处方分析。注射用辅酶A无菌冻干制剂处方中，辅酶A为主药，水解明胶、甘露醇、葡萄糖酸钙为填充剂，半胱氨酸（C对）为稳定剂。